心主神志的最主要物质基础是
A. 津液
B. 精液
C. 宗气
D. 血液
E. 营气

正确答案：D。血液

解析：心主神志即心藏神，血是机体神志活动的主要物质基础，人体的神志活动必须得到血液的营养才能产生充沛而舒畅的精神活动（D对）。津液（A错）是机体一切正常水液的总称，是构成人体和维持生命活动的基本物质之一。精液（B错）是禀受于父母的生命物质与后天水谷精微相融合而形成的一种构成人体和维持人体生命活动的最基本物质。宗气（C错）是由谷气和自然界清气相结合而积聚于胸中的气，呼吸、语言、声音、肢体运动都与之有关。营气（E错）行于脉中，是血液的重要组成部分，为全身脏腑组织提供生理活动的物质基础。